流行病学研究的观察法和实验法的根本区别在于
A. 设立对照组
B. 不设立对照组
C. 是否人为施加干预措施
D. 盲法
E. 统计学检验

正确答案：C。是否人为施加干预措施